以下哪一项不属于腭的表面解剖标志
A. 切牙乳头
B. 腭皱襞
C. 腭大孔
D. 蝶骨翼突钩
E. 翼腭管

正确答案：E。翼腭管

解析：腭的表面解剖标志：硬腭上腭中缝、切牙乳头、腭皱襞、腭大孔和蝶骨翼突钩等。掌握“腭、舌、舌下区的局部解剖”知识点。